与痢疾志贺菌的特性的叙述中，不相符的是
A. 具有O、H、K三种抗原
B. 可合成内毒素和外毒素
C. 菌毛与其侵袭力有关
D. 不取病人血液作细菌分离培养
E. 典型的里急后重症状是由内毒素所致

正确答案：A。具有O、H、K三种抗原

解析：根据志贺菌菌体（O）抗原和分解甘露醇的能力，将其分为4群，即痢疾志贺菌（A群），福氏志贺菌（B群），鲍氏志贺菌（C群）和宋内志贺菌（D群）。该菌属的致病物质主要有菌毛、内毒素和外毒素。菌毛与其侵袭力有关。内毒素作用于肠黏膜，形成炎症和溃疡。肠毒性外毒素即志贺毒素（Stx）与EHEC产生的毒素相同，使上皮细胞损伤。在少数病人，志贺毒素可介导肾小球内皮细胞的损伤，导致溶血性尿毒综合征（HUS）。该菌属引起急性及慢性细菌性痢疾，急性中毒性痢疾多见于小儿。发病率在中国传染病中位居前五位。掌握“志贺氏及沙门氏菌属”知识点。